麻疹发病年龄多见于
A. 1～5岁
B. 5～10岁
C. 6个月～1岁
D. 3～5岁
E. 10～18岁

正确答案：A。1～5岁

解析：麻疹是小儿时期常见的一种急性呼吸道传染病，临床以发热、上呼吸道炎症、结膜炎、麻疹黏膜斑及全身斑丘疹为特征。未患本病也未接受麻疹疫苗接种者对本病易感，特别是6个月以上、5岁以下小儿更易罹患（A对）。